Chance骨折是指胸腰椎
A. 单纯性压缩骨折
B. 骨折-脱位
C. 屈曲-牵拉性损伤
D. 稳定性爆破型骨折
E. 水平状撕裂性损伤

正确答案：E。水平状撕裂性损伤

解析：Chance骨折（E对）是指胸腰椎的水平状撕裂性损伤，属于不稳定骨折。单纯性压缩骨折（A错）指胸腰椎椎体前方受压缩楔形变。骨折-脱位（B错）指脊柱骨折并脱位，可伴有关节突关节脱位或骨折。屈曲-牵拉性损伤（C错）多见于颈椎骨折。稳定性爆破型骨折（D错）指椎体呈粉碎骨折，骨折块向四周移位。